呈不规则厚片，横切面有黄白色维管束小点5～13个环状排列的饮片是
A. 炮附片
B. 绵马贯众
C. 地榆
D. 狗脊
E. 白芷

正确答案：B。绵马贯众

解析：本题考查的是绵马贯众药材的性状鉴别。呈不规则厚片，横切面有黄白色维管束小点5～13个环状排列的饮片是绵马贯众（B对）。绵马贯众：【性状鉴别】药材呈长倒卵形，略弯曲，上端钝圆或截形，下端较尖，有的纵剖为两半。表面黄棕色至黑褐色，密被排列整齐的叶柄残基及鳞片，并有弯曲的须根。叶柄残基呈扁圆形；表面有纵棱线，质硬而脆，断面略平坦，棕色，有黄白色维管束5～13个，环列；每个叶柄残基的外侧常有3条须根，鳞片条状披针形，全缘，常脱落。质坚硬，断面略平坦，深绿色至棕色，有黄白色维管束5～13个，环列，其外散有较多的叶迹维管束。气特异，味初淡而微涩，后渐苦、辛。炮附片（A错）：【性状鉴别】形如黑顺片与白附片。表面鼓起，黄棕色。质松脆。气微，味淡。地榆（C错）：【性状鉴别】饮片呈不规则的类圆形片或斜切片。外表皮灰褐色至深褐色。切面较平坦，粉红色、淡黄色或黄棕色，木部略显呈放射状排列；或皮部有多数黄棕色绵状纤维。气微，味微苦涩。狗脊（D错）：【性状鉴别】药材生狗脊片呈不规则长条形或圆形；切面浅棕色，较平滑，近边缘处有1条棕黄色隆起的木质部环纹或条纹，边缘不整齐。偶有金黄色绒毛残留；质脆，易折断，有粉性。白芷（E错）：【性状鉴别】饮片为类圆形的厚片。外表皮灰棕色或黄棕色。切面白色或灰白色，显粉性，形成层环棕色，近方形或近圆形，皮部散有多数棕色油点。气芳香，味辛、微苦。